下列泄下粪便中辨出何为湿热泄泻的特点
A. 泄泻清稀
B. 泻下如水样便
C. 泻下粪色黄褐而臭
D. 泻下粪便臭如败卵
E. 时溏时泄、水谷不化

正确答案：C。泻下粪色黄褐而臭

解析：泄泻之湿热伤中证，其机理为湿热壅滞，损伤脾胃，传化失常；湿热阻于中焦，不通则痛，故腹痛；暴注下迫，皆属于热，肠中有热，可表现为泄泻、泻下急迫；湿热互结，则泻而不爽；湿热下注，故肛门灼热，粪便色黄褐而臭（C对）。